下列哪种职业中毒会导致肝血管肉瘤
A. 二异氰酸甲苯酯
B. 氯乙烯
C. 聚乙烯
D. 含氟塑料

正确答案：B。氯乙烯

解析：本题考查引发肝血管肉瘤的职业中毒。肝血管肉瘤，是一种极其罕见又很难诊断的高度恶性肝肿瘤。多为先天性，常见于婴儿，偶见于老年人。职业性的肝血管肉瘤主要与接触氯乙烯（B对ACD错）有关，多见于接触高浓度氯乙烯的清釜工。